下列描述的微生物中，不是所有微生物共同特征的是
A. 形体微小
B. 分布广泛
C. 数量繁多
D. 可无致病性
E. 只能在活细胞内生长繁殖

正确答案：E。只能在活细胞内生长繁殖

解析：本题考查微生物定义、分类及特点。只能在活细胞内生长繁殖（E错，为本题正确答案）不是所有微生物共同特征。真核细胞型微生物易在体外生长繁殖。微生物是广泛存在于自然界的形体微小（A对）、分布广泛（B对）、数量繁多（C对）、肉眼看不见，需借助于光学显微镜或电子显微镜放大数百倍、上千倍甚至数万倍，才能观察到的最低等的微小生物，可无致病性（D对）。